预防儿童及青少年过多饮用碳酸饮料所致酸蚀症，最主要的是
A. 治疗相关疾病
B. 使用含氟牙膏刷牙
C. 避免酸性环境与酸接触
D. 咀嚼无糖口香糖促进唾液分泌
E. 改变不良饮食习惯及口腔卫生习惯

正确答案：E。改变不良饮食习惯及口腔卫生习惯

解析：本题考查酸蚀症的预防。预防儿童及青少年过多饮用碳酸饮料所致酸蚀症，最主要的是改变不良饮食习惯及口腔卫生习惯（E对）。酸蚀症的预防：1.加强口腔健康教育；2.治疗可引起牙酸蚀症的疾病；3.减少饮食中的酸对牙的侵蚀；4.避免在酸性环境中与酸的接触；5.增强牙对酸的抵抗力；6.改变不良饮食习惯及口腔卫生习惯。治疗相关疾病（A错）；使用含氟牙膏刷牙（B错）；避免酸性环境与酸接触（C错）；咀嚼无糖口香糖促进唾液分泌（D错）均可以预防酸蚀症，但不是预防儿童及青少年过多饮用碳酸饮料所致酸蚀症的最主要的措施。